患者冠心病史3年，晨痛持续剧烈，甚则心痛彻背，背痛彻心，含服硝酸甘油后不能缓解，且胸闷心痛，动则加重，神疲乏力，气短懒言，心悸自汗，舌体胖大，有齿痕，舌质暗淡，苔薄白，脉细弱无力。诊断为急性心肌梗死，气虚血瘀证。其治法是
A. 活血化瘀，通络止痛
B. 散寒宣痹，芳香温通
C. 温阳利水，通脉止痛
D. 益气滋阴，通脉止痛
E. 益气活血，祛瘀止痛

正确答案：E。益气活血，祛瘀止痛

解析：气郁日久，瘀血内停，络脉不通故见晨痛持续剧烈，甚则心痛彻背，背痛彻心，含服硝酸甘油后不能缓解；气虚不能推动故见神疲乏力，气短懒言，动则加重；气虚失于固摄则心悸自汗；舌体胖大，有齿痕，舌质暗淡，苔薄白，脉细弱无力均为气虚血瘀之侯，故可以诊断为急性心肌梗死，气虚血瘀证，治疗需益气活血，祛瘀止痛（E对）。活血化瘀，通络止痛（A错）用于治疗气滞血瘀证。散寒宣痹，芳香温通（B错）用于治疗寒凝心脉证。温阳利水，通脉止痛（C错）用于治疗阳虚水泛证。益气滋阴，通脉止痛（D错）治疗气阴两虚证。